男，57岁。酒精性肝硬化15年。1个月出现右上腹胀痛，低热，体重下降。最可能诊断
A. 肝脓肿
B. 肝血管瘤
C. 肝囊肿
D. 原发性肝癌
E. 胃癌

正确答案：D。原发性肝癌

解析：中年男性患者，酒精性肝硬化15年病史（长期大量饮酒导致酒精性肝病，在此基础上的肝纤维化及肝硬化过程都可能引起肝癌），1个月出现右上腹胀痛（原发性肝癌最常见的症状），低热、体重下降（原发性肝癌的全身性表现），综合患者的病史、临床表现，可初步诊断为原发性肝癌（D对）。肝脓肿（九版外科学P415）（A错）患者起病较急，主要症状为寒战高热（体温可高达39℃～40℃），肝区疼痛和肝肿大。肝血管瘤（九版外科学P421）（B错）常见于中年女性，瘤体较小时无任何症状，增大后主要表现为肝大或压迫胃、十二指肠等邻近器官，引起上腹部不适、腹胀、嗳气、腹痛等症状。胃癌（九版外科学P347）（E错）患者也可以有右上腹胀痛，低热，体重下降等表现，一般无酒精性肝硬化的病史。